与鼓室相通的管道是
A. 外耳道
B. 内耳道
C. 咽鼓管
D. 颈动脉管
E. 还具有营养角膜和晶状体以及维持眼内压作用

正确答案：C。咽鼓管

解析：中耳向外借鼓膜与外耳道（A错）相隔。前壁，即颈动脉管的后壁，隔开鼓室于颈动脉管（D错）。咽鼓管骨部（C对）向后外侧开口于鼓室前壁的咽鼓管鼓室口。内耳道（B错）位于颞骨岩部后面的中部，与鼓室不相通。E选项与题干无关。